属于抗血小板药品有
A. 氯吡格雷
B. 双嘧达莫
C. 替罗非班
D. 华法林
E. 阿司匹林

正确答案：A、B、C、E。氯吡格雷；双嘧达莫；替罗非班；阿司匹林

解析：本题考查抗血小板药。属于抗血小板药品有氯吡格雷（A对）、双嘧达莫（B对）、替罗非班（C对）和阿司匹林（E对）。抗血小板药按作用机制可分为：（1）环氧酶抑制剂：代表药为阿司匹林。（2）二磷酸腺苷P2Y12受体阻断剂：如氯吡格雷。（3）整合素受体阻断剂，分3类：单克隆抗体如阿昔单抗；非肽类抑制剂有替罗非班；合成肽类抑制剂如依替非巴肽等。（4）磷酸二脂酶抑制剂：双嘧达莫。（5）血小板腺苷环化酶刺激剂：有肌苷、前列环素等。（6）血栓烷合成酶抑制剂：奥扎格雷钠。